男，28岁。车祸后昏迷3周。查体：昏迷，压眶反射消失，颈后仰伸，四肢强直性伸直，上肢内收、过度旋前和下肢内收、内旋、踝跖屈。该患者的损害水平在
A. 脊髓
B. 脑干
C. 大脑皮层
D. 小脑
E. 基底节

正确答案：B。脑干

解析：患者中青年男性，车祸后昏迷3周，查体：昏迷，压眶反射消失，颈后仰伸，四肢强直性伸直，上肢内收过度旋前和下肢内收、内旋、踝跖屈（典型的去大脑僵直的姿势），可诊断去大脑僵直。去大脑僵直是中脑水平受损而导致的伸肌紧张性亢进，临床表现为四肢强直性伸展，颈后伸，甚至角弓反张、肩下抑、上臂内收内旋、前臂伸直、过度旋前、髋部内收内旋、膝伸直、踝跖屈。舌可稍向前伸。故该患者的损害水平在脑干（B对）。此题易误诊去皮层综合症而选C，去皮层综合症时表现身体姿势为上肢屈曲内收，腕及手指屈曲，双下肢伸直，足屈曲。脊髓（A错）会导致受损平面以下瘫痪（若已在脊髓前角细胞换元则表现为软瘫，若没换元则表现为硬瘫），但不会出现颈后仰伸，四肢强直性伸直，上肢内收过度旋前和下肢内收、内旋、踝跖屈这样的体征。小脑（D错）损伤主要表现为共济失调。基底节（E错）主要表现为舞蹈样动作、手足徐动或静止性震颤等症状，一般无深度昏迷表现。